既治饮食积滞、湿热内阻所致的脘腹胀痛、不思饮食、大便秘结，又治食积湿热、内阻肠胃所致的痢疾里急后重的成药是
A. 保和丸
B. 芩连丸
C. 六味安消散
D. 枳实导滞丸
E. 葛根芩连丸

正确答案：D。枳实导滞丸

解析：本题考查的是枳实导滞丸的主治。既治饮食积滞、湿热内阻所致的脘腹胀痛、不思饮食、大便秘结，又治食积湿热、内阻肠胃所致的痢疾里急后重的成药是枳实导滞丸（D对）。枳实导滞丸：【主治】饮食积滞、湿热内阻所致的脘腹胀痛、不思饮食、大便秘结、痢疾里急后重。保和丸（A错）：【主治】食积停滞，脘腹胀满，嗳腐吞酸，不欲饮食。芩连片（B错）：【主治】脏腑蕴热，头痛目赤，口鼻生疮，热痢腹痛，湿热带下，疮疖肿痛。六味安消散（C错）：【主治】脾胃不和、积滞内停所致的胃痛胀满、消化不良、便秘、痛经。葛根芩连丸（E错）：【主治】湿热蕴结所致的泄泻腹痛、便黄而黏、肛门灼热；以及风热感冒所致的发热恶风、头痛身痛。